医务人员的行为规范内容包括
A. 尊重科学
B. 规范行医
C. 严格报告
D. 救死扶伤
E. 以上均正确

正确答案：E。以上均正确

解析：医务人员的行为规范，其内容有：尊重科学、规范行医、重视人文、规范文书、严格报告、救死扶伤、严格权限、规范试验。掌握“医学伦理学的基本规范”知识点。